根据面神经在颅外的行程及其与腮腺的关系，面神经五组分支从腮腺边缘走出，呈放射状分布于面部表情肌的一段是
A. 第一段
B. 第二段
C. 第三段
D. 第四段
E. 第五段

正确答案：C。第三段

解析：腮腺与面神经关系密切，根据面神经在颅外的行程及其与腮腺的关系，将其分为三段，第一段指面神经干从茎乳孔穿出到进入腮腺前的一段，显露面神经主干可在此处进行；第二段在腮腺内；第三段为面神经五组分支从腮腺边缘走出，呈放射状分布于面部表情肌的一段。掌握“腮腺咬肌区、腮腺与面神经解剖关系”知识点。